下列症状不属于口腔癌警告标志的是
A. 原因不明的口腔反复出血
B. 口腔内溃疡1周尚未愈合
C. 口腔黏膜有白色、红色和发暗的斑
D. 口腔与颈部不正常的肿胀和淋巴结肿大
E. 面部、口腔、咽部、颈部不明原因的麻木和疼痛

正确答案：B。口腔内溃疡1周尚未愈合

解析：本题考查口腔癌的警告标志。口腔癌警告标志：①口腔内有2周以上未愈合的溃疡（B错，为本题的正确答案）；②口腔黏膜有白色、红色和发暗的斑（C对）；③口腔与颈部有不明原因的肿胀和淋巴结肿大（D对）；④口腔内有不明原因的反复出血（A对）；⑤面部、口腔、咽部和颈部有不明原因的麻木与疼痛（E对）。